某女，32岁。头晕眼花，心悸多梦，面色苍白，瓜甲色淡，舌淡，苔薄白，脉细。治疗宜选用的中成药有
A. 八珍颗粒
B. 四神丸
C. 十全大补膏
D. 当归补血口服液
E. 六味地黄丸

正确答案：A、C、D。八珍颗粒；十全大补膏；当归补血口服液

解析：本题考查月经过多之气虚证的中成药应用。结合患者症状为月经过多之气虚证，治疗宜选用的中成药有八珍颗粒（A对）、十全大补膏（C对）、当归补血口服液（D对）。月经过多之气虚证【症状】经行量多，色淡红，质清稀；神疲肢倦，气短懒言，小腹空坠，面色㿠白。舌淡，苔薄，脉细弱。【中成药应用】常用中成药有当归丸、益气养元颗粒、八珍颗粒、十全大补丸、十全大补膏、当归补血口服液。泄泻之肾阳虚衰证【症状】黎明前脐腹作痛，肠鸣即泻，泻后则安，完谷不化，腹部喜暖，形寒肢冷，腰膝酸软。舌淡苔白，脉沉细。【中成药应用】常用中成药有四神丸（B错）、桂附理中丸、固本益肠片、肠胃宁片。消渴之肾阴亏虚证【症状】尿频量多，浊如膏脂，腰酸膝软，头晕耳鸣，多梦遗精，乏力，皮肤干燥。舌红少苔，脉细数。【中成药应用】常用中成药有六味地黄丸（E错）（水蜜丸）、麦味地黄丸（水蜜丸）。